冬季畜肉僵直一般出现在宰后
A. 1.5小时
B. 3～4小时
C. 6～8小时
D. 15～26小时
E. 1～3天

正确答案：B。3～4小时

解析：本题考查冬季畜肉僵直出现的时间。僵直是指刚宰杀的畜肉中糖原和含磷有机化合物在组织酶的作用下分解为乳酸和游离磷酸，使肉的酸度增加，达到肌凝蛋白等电点后开始凝固，导致肌纤维硬化的过程。冬季畜肉僵直一般出现在宰后3～4小时（B对ACDE错）。